评价居住区规划卫生的指标不包括
A. 人均居住面积定额
B. 建筑容积率
C. 居住区人口密度
D. 采光系数
E. 居住建筑密度

正确答案：D。采光系数

解析：本题考查居住区规划卫生评价指标。评价居住区规划卫生的指标包括：1.容积率（B对）：是指居住区总建筑面积与建筑用地面积的比值，这个比值越小，则居住区容纳的建筑总量越少；2.居住建筑密度（E对）：是居住用地内，各类建筑的基底总面积与居住区用地面积的比率。选定居住建筑密度和人均居住面积定额（A对）后，可计算所需的人均居住建筑用地面积；3.居住区人口密度（C对）：单位居住用地上居住的人口数量，称为人口毛密度。单位住宅用地上居住的人口数量，称为人口净密度。采光系数（D错，为本题正确答案）用来反映当地光气候、采光口大小、位置、朝向的情况，以及室外遮光物等有关影响因素。